因作用弱，常与其他利尿药合用的药物是
A. 甘露醇
B. 氢氯噻嗪
C. 呋塞米
D. 阿米洛利
E. 螺内酯

正确答案：E。螺内酯

解析：本题考查螺内酯。螺内酯（E对）及其代谢产物坎利酮结构与醛固酮相似，可结合到胞质中的盐皮质激素受体上，阻止醛固酮-受体复合物的核转位，而产生拮抗醛固酮的作用。常与噻嗪类利尿剂合用可以减少噻嗪类利尿剂引起的钾丢失。甘露醇（A错）为渗透性利尿药。氢氯噻嗪（B错）为噻嗪类利尿药，直接抑制远曲小管初段腔壁上的Na⁺-Cl⁻共转运子的功能，使肾小管上皮细胞对Na⁺、Cl⁻和水的排出减少。呋塞米（C错）为袢利尿剂，主要作用于髓袢升支粗段，降低肾的稀释与浓缩功能，利尿作用快、强、短。阿米洛利（D错）为肾小管上皮细胞钠离子通道抑制剂，为低效的保钾利尿药。